作为医学伦理学基本范畴的良心指的是
A. 医学关系中的主体在道义上应享有的权力和利益
B. 医学关系中的主体在道义上应履行的职责和使命
C. 医学关系中的主体在道义上对周围人事以及自身的内心体验和感受
D. 医学关系中的主体在对自己应尽义务的自我认识和自我评价的能力
E. 医学关系中的主体在表现出行为前的周密思考和行为中的谨慎负责

正确答案：D。医学关系中的主体在对自己应尽义务的自我认识和自我评价的能力

解析：良心是医务人员自身内部的道德评价，是自己对自己的医学伦理行为道德价的意识，简言之就是自我道德评价。如果是对自己的医学伦理行为所具有的正道德价值的肯定性评价，叫作良心满足；如果是对自己的医学伦理行为所具有的负道德价值的否定性评价，便叫作良谴责。作为医学伦理学基本范畴的良心指的是医学关系中的主体在对自己应尽义务的自我认识和自我评价的能力（D对）。一个有良心的医务人员，如果看到自己的行为符合医学道德要求因自己做一个好人的道德需要得到满足和实现而感到快乐，沉浸在良心满足的喜悦之中；相反，如果看到自己的行为不符合医学道德要求，便会因做一个好人的道德需要就没有得满足和实现而到内疚，便会遭受良谴责的痛苦折磨。良心能够促使医务人员遵守医学道德规范（ABCE错）。